软膏剂质量评价不包括的项目是
A. 粒度
B. 装量
C. 微生物限度
D. 无菌
E. 热原

正确答案：E。热原